无（牙合）支托，可设计为颊侧固位臂和舌侧对抗臂属于哪种锻丝卡环形式
A. 连续卡环
B. 尖牙卡环
C. 双臂卡环
D. 三臂卡环
E. 圈形卡环以上为锻丝卡环的各种类型

正确答案：C。双臂卡环

解析：双臂卡环：有颊、舌两个卡环臂，无（牙合）支托，可设计为颊侧固位臂和舌侧对抗臂。掌握“局部义齿固位体”知识点。